治疗气虚感冒，应首选
A. 玉屏风散
B. 再造散
C. 参苏饮
D. 加减葳蕤汤
E. 杏苏散

正确答案：C。参苏饮

解析：气虚感冒治宜益气解表，首选参苏饮（C对）。若表虚自汗，易伤风邪者，可常服玉屏风散益气固表，以防感冒（A错）；若见恶寒重，发热轻，四肢欠温，语音低微，舌质淡胖，脉沉细无力，为阳虚外感，当助阳解表，用再造散加减。（B错）阴虚感冒治宜滋阴解表，方选加减葳蕤汤（D错）。凉燥咳嗽治宜疏风散寒，润肺止咳，方选杏苏散（E错）。